前牙金瓷冠中唇面瓷层的厚度一般为
A. 0.5mm
B. 1mm
C. 2mm
D. 2.5mm
E. 3mm

正确答案：B。1mm

解析：本题考查前牙金瓷冠中唇面瓷层的厚度。前牙金瓷冠中唇面瓷层的厚度一般为1mm（B对）。瓷材料可分为遮色瓷、牙本质瓷、牙釉质瓷，遮色瓷是决定金-瓷结合的关键瓷；牙本质瓷又称体瓷，它是金属烤瓷冠的基本颜色，再现牙本质半透明瓷层；釉质瓷相当于天然牙釉质的瓷，几乎没有什么颜色的瓷层。